某项研究选择50名生育短肢畸形婴儿的母亲和90名生育正常婴儿的母亲，调查她们在怀孕初期是否服用过反应停，两组母亲分别有12人和2人回答服用过。利用上述资料回答下列问题。此研究可以计算的指标是
A. RR
B. 比值比
C. 发病率
D. 患病率
E. AR

正确答案：B。比值比

解析：本题考查病例对照研究的测量指标。病例对照研究中没有暴露组和非暴露组的观察人数，不能计算发病率和RR，但可用比值比（B对ACDE错）来近似描述暴露与疾病联系强度。